锥体外系损害常见的症状是
A. 感觉障碍
B. 肌张力障碍
C. 视觉障碍
D. 平衡障碍
E. 痛性麻痹

正确答案：B。肌张力障碍

解析：锥体外系统的主要功能是：调节肌张力，协调肌肉运动，维持和调整体态姿势，担负半自动的刻板动作及反射性运动。锥体外系受损后最常出现肌张力障碍（B对）和不自主运动两大类症状，如帕金森的肌张力增高和运动减少及舞蹈症的肌张力减低和不自主运动；一般没有瘫痪，感觉和共济系统也不受累，故少有感觉障碍（A错）、视觉障碍（C错）、痛性麻痹（E错）、平衡障碍（D错）等症状出现。